关于急性根尖周炎发展过程描述哪项是错误的
A. 是根尖部牙周膜出现浆液性炎症到形成化脓性炎症的一系列反应过程
B. 是一个程度由轻到重，范围由小到大的连续过程
C. 病程发展到高峰时，已是牙槽骨的局限性骨髓炎
D. 严重时还将发展为颌骨骨髓炎
E. 有时也可由重到轻，自行愈合

正确答案：E。有时也可由重到轻，自行愈合

解析：本题考查急性根尖周炎的发展过程。关于急性根尖周炎发展过程错误的是有时也可由重到轻，自行愈合（E错，为本题的正确答案）。急性根尖周炎是根尖部牙周膜出现浆液性炎症到根尖周组织形成化脓性炎症的一系列反应过程（A对），是一个病变程度由轻到重、病变范围由小到大的连续过程（B对），不可自愈，病程发展到高峰时，炎症扩散，牙槽骨病变已发展为局限性骨髓炎（C对），若不及时治疗，严重时还将发展为颌骨骨髓炎（D对）。